根据《药品经营质量管理规范实施条例》，不合格药品库
A. 红色色标
B. 黄色色标
C. 绿色色标
D. 蓝色色标
E. 橙色色标

正确答案：A。红色色标

解析：本题考察色标管理。不合格药品库使用红色色标（A对）。